治疗心脏骤停宜首选
A. 静滴去甲肾上腺素
B. 舌下含异丙肾上腺素
C. 静滴地高辛
D. 肌注尼可刹米
E. 心内注射肾上腺素

正确答案：E。心内注射肾上腺素